Ⅰ相反应包括
A. 氧化
B. 还原
C. 水解
D. 结合
E. A+B+C

正确答案：E。A+B+C